男性，32岁。十二指肠溃疡病史1年，口服药物治疗，因12小时前呕吐鲜血来诊，血压为80/50mmHg，输血1000ml后，血压仍有波动。查体：贫血貌，剑突下压痛，腹软，此病人最适宜的治疗方法是
A. 快速补液、输血
B. 静脉注射止血药
C. 胃镜电凝止血
D. 急诊剖腹手术
E. 应用血管活性药物

正确答案：D。急诊剖腹手术

解析：中年男性患者，有十二指肠溃疡病史、呕血，应诊断为上消化道大出血。患者十二指肠溃疡病史较长，呕血后血压降至80/50mmHg（休克），及时进行扩容输血后，血压仍有波动，说明快速补液、输血（A错）治疗无效，患者体内仍在出血，纠正难以休克。此时，该患者应在进行输血等保守治疗措施的同时，积极进行急诊剖腹手术（D对），纠正休克。抗休克治疗应立足于综合治疗，静脉注射止血药（B错）、胃镜电凝止血（C错）、应用血管活性药物（E错）为保守治疗，而该患者上消化道出血快、出血量大，保守治疗难以去除病因，效果不佳，故其不是最适宜的治疗方法。